分析方法验证指标的定义是:检测限
A. 分析方法的测定结果与真实值或参考值接近的程度
B. 同一均匀样品经多次取样测定所得结果之间的接近程度
C. 在其他组分可能存在的情况下，分析方法能准确地测出被测组分的能力
D. 分析方法所能检出试样中被测组分的最低浓度或最低量
E. 分析方法可定量测定试样中被测组分的最低浓度或最低量

正确答案：D。分析方法所能检出试样中被测组分的最低浓度或最低量